中位生存时间可以理解为
A. 生存时间的中位数
B. 平均生存时间
C. 样本中50%的对象的生存期超过这个时间点
D. 估计研究人群中的对象生存期超过这个时间点的机会为50%

正确答案：C。样本中50%的对象的生存期超过这个时间点

解析：本题考查中位生存时间。中位生存时间是指生存函数取值为0.5时对应的生存时间，可以理解为样本中50%的对象的生存期超过这个时间点（C对ABDE错）。